Murphy征阳性提示
A. 细菌性肝脓肿
B. 急性胆管炎
C. 肝总管结石
D. 左肝管结石
E. 急性胆囊炎

正确答案：E。急性胆囊炎

解析：Murphy征阳性是指医师用左手掌平放于患者右胸下部，以拇指指腹勾压于右肋下胆囊点处，嘱患者缓慢深吸气，在吸气的过程中发炎的胆囊下移时碰到用力按压的拇指，引起胆囊触痛，如因剧烈腹痛而致吸气终止。Murphy征阳性提示急性胆囊炎（E对）。